双香豆素过量引起的出血可用
A. 硫酸鱼精蛋白
B. 叶酸
C. 维生素K
D. 尿激酶
E. 维生素B₁₂

正确答案：C。维生素K